颌面外科最常使用的固定方法是
A. 保守治疗
B. 单颌固定
C. 颌间结扎
D. 切开复位内固定术
E. 暂不处理，随访

正确答案：C。颌间结扎

解析：颌间固定指利用牙弓夹板将上、下颌固定在一起的方法，是颌面外科最常使用的固定方法。它的优点是能使移位的骨折段保持在正常咬合关系上愈合。常用的方法有带钩牙弓夹板颌间固定、小环颌间结扎固定和正畸托槽颌间固定。掌握“牙槽突骨折、颌骨骨折”知识点。